乙状结肠扭转最具有特征的表现是
A. 多发于2岁以下的儿童
B. 经常有腹泻及便秘交替
C. 腹部X线平片见马蹄状巨大的双腔充气肠袢
D. 低压灌肠，往往灌注1000ml，而无法排出;
E. 钡剂灌肠见扭转部位钡剂受阻，呈”杯口“状

正确答案：C。腹部X线平片见马蹄状巨大的双腔充气肠袢

解析：乙状结肠扭转多见于老年人（A错），典型的腹部X线表现为马蹄状巨大的双腔充气肠袢（C对），钡剂灌肠X线检查见扭转部位钡剂受阻，钡影尖端呈“鸟嘴”形（E错）。乙状结肠扭转时，肛门停止排便排气，经常有腹泻及便秘交替为肠结核的表现（B错）。乙状结肠扭转为闭袢性肠梗阻，如作低压灌肠，往往不足500ml便不能再灌入（D错）（七版外科学P458）。钡剂灌肠见扭转部位钡剂受阻，呈”杯口“状为肠套叠的表现。